青春期开始的重要标志为
A. 卵泡开始发育
B. 出现周期性排卵
C. 第一次月经来潮
D. 开始出现第2性征
E. 出现体格发育第2高峰

正确答案：C。第一次月经来潮

解析：女性第一次月经来潮称月经初潮，为青春期的重要标志（C对）。青春期体格发育第2高峰（E错）晚于乳房发育。在青春期开始阶段，卵巢功能尚不健全，月经初潮后月经周期及排卵多无规律性（B错）。乳房萌发是女性第二性征的最初特征，开始出现第二性征发生在青春期初始阶段，但不是重要标志（D错）。